孕妇患梅毒时首选的治疗药物是
A. 青霉素
B. 多西环素
C. 四环素
D. 头孢曲松
E. 红霉素

正确答案：A。青霉素

解析：梅毒首选药物为青霉素，孕妇患梅毒首选亦为青霉素（A对）。多西环素（B错）为广谱抑菌剂，高浓度时具杀菌作用；四环素（C错）对革兰氏阳性菌、阴性菌、立克次体、滤过性病毒、螺旋体属乃至原虫类都有很好的抑制作用；头孢曲松（D错）针对敏感致病菌所引起的各种感染，特别是重症、危症和其它抗生素治疗无效的病例；红霉素（E错）抗菌谱与青霉素近似，对革兰阳性菌，如葡萄球菌、化脓性链球菌、绿色链球菌、肺炎链球菌、粪链球菌、梭状芽孢杆菌、白喉杆菌等有较强的抑制作用。